由混合性的需氧和厌氧菌引起的感染可达
A. 0.05
B. 0.15
C. 0.35
D. 0.6
E. 0.9

正确答案：D。0.6

解析：口腔颌面部感染常由金黄色葡萄球菌、溶血性链球菌、大肠杆菌等引起。牙源性感染大多由需氧和厌氧菌混合感染造成。由单纯需氧菌引起的颌面部感染约为5%，由单纯厌氧菌引起的感染约为35%，而由混合性的需氧和厌氧菌引起的感染可达60%。掌握“口腔颌面部感染概论”知识点。